髋肌中不包括
A. 髂肌
B. 阔筋膜张肌
C. 梨状肌
D. 短收肌
E. 无

正确答案：D。短收肌

解析：髋肌包括髂肌(A对)、阔筋膜张肌（B对）和梨状肌（C对），短收肌（D错，为本题正确答案）不属于髋肌。